阿司匹林及其栓剂的含量测定方法分别是
A. 直接中和法与分光光度法
B. 直接中和法与两步滴定法
C. 直接中和法与高效液相色谱法
D. 两步滴定法与高效液相色谱法
E. 两步滴定法与分光光度法

正确答案：C。直接中和法与高效液相色谱法